具有散肿止痛功效的药物是
A. 白头翁
B. 山豆根
C. 二者均是
D. 二者均不是

正确答案：B。山豆根

解析：本题考查的是山豆根的功效。具有散肿止痛功效的药物是山豆根（B对）。山豆根：【功效】清热解毒，消肿利咽。【主治病证】（1）火毒蕴结之咽喉肿痛，肺热咳嗽。（2）牙龈肿痛，痈肿疮毒，湿热黄疸。白头翁（A错）：【功效】清热解毒，凉血止痢。